热毒痢疾宜选用
A. 乌梅丸
B. 芍药汤
C. 四神丸
D. 白头翁汤
E. 真人养脏汤

正确答案：D。白头翁汤

解析：主治热毒痢疾的是白头翁汤，本证是因热毒深陷血分，下迫大肠所致，治以清热解毒，凉血止血（D对）。乌梅丸用于痢疾证属寒热错杂者（A错）。芍药汤为湿热痢的代表方（B错）。四神丸用于久痢兼见肾阳虚衰，关门不固者（C错）。桃花汤和真人养脏汤为虚寒痢的代表方（E错）。